化学物质的哪些物理性质影响毒效应
A. 电离度
B. 熔点
C. 挥发度
D. 以上都是

正确答案：D。以上都是

解析：本题考查化学物的理化性质。化学物的理化特性可影响其吸收、分布、蓄积、代谢和排泄过程，以及在靶器官中的浓度，进而影响毒作用的性质和大小。如电离度、熔点、挥发度（D对ABC错）等均能影响毒效应。